可引起读码框移位的突变是
A. 转换
B. 颠换
C. 点突变
D. 缺失终止密码子
E. 插入10个核苷酸

正确答案：E。插入10个核苷酸